奶的消毒方法不包括
A. 煮沸消毒法
B. 巴氏消毒法
C. 超高温瞬间灭菌法
D. 蒸汽消毒法
E. 紫外线杀菌

正确答案：E。紫外线杀菌

解析：本题考查奶的消毒方法。奶的消毒方法包括：1.巴氏消毒法（B对）：即利用较低的温度来杀死致病菌，却又能保持乳中营养成分和风味基本不变的消毒法；2.超高温瞬间灭菌法（C对）：将乳于130～150℃加热0.5～3秒；3.煮沸消毒法（A对）：将乳直接加热煮沸，保持10分钟；4.蒸汽消毒法（D对）：将瓶装生乳置蒸汽箱或蒸笼中，加热至蒸汽上升后维持10分钟，此时乳温可达85℃。紫外线杀菌（E错，为本题正确答案）不是奶的消毒方法。